小儿发热持续不退，午后发热较高，适逢夏季，气温愈高，发热愈高，口渴多饮，皮肤干燥，无汗，口唇干燥，纳呆食少，小便频数量多，舌红，脉数。治疗应首选方剂
A. 白虎汤
B. 新加香薷饮
C. 竹叶石膏汤
D. 温下清上汤
E. 王氏清暑益气汤

正确答案：E。王氏清暑益气汤

解析：本病例以发热，且季节为夏季，伴口渴多饮、多尿、无汗为主诉，故诊断为夏季热。患儿禀赋不足，胃受暑气，蕴于肺胃，灼伤阴津，津亏而内热炽盛，暑气熏蒸，故小儿发热持续不退，午后发热较高，适逢夏季，口渴多饮；气温愈高，不耐暑气，故发热愈高；肺津伤则化源不足，水液无以输布，故皮肤干燥，无汗；暑易夹湿，故纳呆食少；口唇干燥，舌红，脉数，均为肺胃阴津被灼之象，故其证候为暑伤肺胃证，治以清暑益气，养阴生津，方药为王氏清暑益气汤（E对）。白虎汤（A错）其功用为清热生津，适用于气分热盛证，其清热之力强，养阴之功弱。新加香薷饮（B错）其功用为清暑解表，适用于暑邪感冒。竹叶石膏汤（C错）其功用为清热生津，益气和胃，适用于伤寒、温病、暑病余热未清，气津两伤证，临床部分医家用于治疗本证，本题需参考教材内容。温下清上汤（D错）其功用为温补肾阳，清心护阴，适用于夏季热之上盛下虚证。